男性，50岁。腹股沟三角突出，半球形包块，易还纳，未进入阴囊，不透光，主要考虑为
A. 鞘膜积液
B. 隐睾
C. 股疝
D. 斜疝
E. 直疝

正确答案：E。直疝

解析：中年男性患者，腹股沟区突出一半球形包块（提示腹股沟疝），未进入阴囊（可排除腹股沟斜疝），不透光（可排除鞘膜积液），结合患者病史和临床表现，主要考虑为腹股沟直疝（E对）。直疝常见于年老体弱者，表现为腹股沟区半球形的肿块，易还纳，很少进入阴囊。鞘膜积液（A错）多表现为阴囊肿块，透光试验阳性。隐睾症（B错）多见于小儿，表现为阴囊空虚，触诊时不能触及睾丸。股疝（C错）多见于40岁以上的女性，肿块位于腹股沟韧带下方，不易还纳。斜疝（D错）多见于儿童及青壮年，肿块呈梨形或椭圆形，可进入阴囊。